长期缺乏钙和维生素D可导致以下症状，除了
A. 儿童生长发育迟缓
B. 儿童龋齿
C. 肾结石
D. 成年人的骨质疏松
E. 成年人的骨软化

正确答案：C。肾结石